霍乱的传染源主要是
A. 患者
B. 家畜
C. 毛蚶
D. 鼠类
E. 蚊虫

正确答案：A。患者

解析：霍乱是由霍乱弧菌所致的烈性肠道传染病，发病急、传播快，是亚洲和非洲大部分地区腹泻的重要原因，属国际检疫传染病。在《中华人民共和国传染病防治法》中被列为甲类传染病。典型临床表现为：急骤起病，剧烈的水样腹泻、呕吐以及由此引起的脱水、电解质紊乱、肌肉痉挛，严重者可导致周围循环衰竭和急性肾功能衰竭。患者（A对）和带菌者是霍乱的主要传染源。患者在发病期间，可连续排菌，时间一般为5天，亦有长达2周者，尤其是中、重型患者，排菌量较多，每毫升粪便含菌107～109个，污染面广泛，是重要的传染源。轻型患者和隐性感染者不易确诊，常被忽视而得不到及时隔离和治疗，所以这两者在传播疾病上也是重要的传染源。